以下关于恶性黑色素瘤的描述，正确的是
A. 通常由片状或岛状的上皮样黑色素细胞构成
B. 排列成器官样或腺泡样
C. 胞质染色浅
D. 核大、核仁明显
E. 以上均正确

正确答案：E。以上均正确

解析：口腔黑色素瘤通常由片状或岛状的上皮样黑色素细胞构成，排列成器官样或腺泡样，胞质染色浅、核大、核仁明显，有时呈浆细胞样。片状和束状梭形细胞也可见到，一般仅占肿瘤的小部分。偶尔，细胞可以主要或全部为梭形。掌握“恶性黑色素瘤”知识点。